反映药物在体内分布广窄程度的指标是
A. K
B. Cl
C. t1/2
D. Vd
E. F

正确答案：D。Vd

解析：本题考查反映药物在体内分布广窄程度的指标。Vd（D对）是药物的特征参数，对于具体药物来说，V是个确定的值，其值的大小能够表示出该药物的分布特性；F（E错）为吸收系数（0≦F≦1），表示吸收占剂量的分数值；k（A错）为速率常数，用来描述药物在体内吸收、分布、代谢和排泄过程速度与浓度的关系；清除率Cl（B错）是单位时间从体内消除的含药血浆体积；t1/2（C错）为生物半衰期，是指药物在体内的量或血药浓度降低一半所需要的时间。